小腿中段火器伤初期处理时不正确的措施是
A. 要做全身检查
B. 输血补液
C. 清创后缝合伤口
D. 使用破伤风抗毒素血清
E. 给予有效的抗生素

正确答案：C。清创后缝合伤口

解析：火器伤的全身治疗与一般创伤相同，主要是做全身检查（A对）以全面了解伤情，输血补液（B对）积极防治休克，维持呼吸、循环的稳定。局部治疗主要是尽早清创，充分显露伤道，清除坏死和失活组织，清创后不宜一期缝合，因为初期清创时，挫伤区和震荡区参差交错，不易判断。此时应保持伤口引流通畅3～5天，酌情行延期缝合，而非清创后缝合伤口（C错，为本题正确答案）。同时，应进行注射破伤风抗毒素血清（D对）和抗生素（E对）等抗感染措施。